有机磷农药致机体中毒的主要机制是
A. 抑制胆碱酯酶的活性
B. 引起神经功能紊乱
C. 抑制心血管功能，兴奋平滑肌
D. 引起乙酰胆碱的大量释放
E. 以上都是

正确答案：A。抑制胆碱酯酶的活性